患者，男，48岁。两乳内发现疼痛性肿物1周。检查：肿物大小约3cm×3cm×1cm，质地中等，有压痛,位于乳晕中央，界限清楚，可移动。应首先考虑的是
A. 乳癖
B. 乳痨
C. 乳疬
D. 乳岩
E. 乳腺增生病

正确答案：C。乳疬

解析：乳疬是指男、女儿童或中老年男性在乳晕部出现疼痛性结块，相当于西医的乳房异常发育症。乳房稍大或肥大，乳晕下有扁圆形肿块，一般发生于一侧，也可见双侧，质地中等或稍硬，边缘清楚，活动良好，局部有轻度压痛或胀痛感，该患者临床表现与之符合，故首先考虑乳疬（C对）。乳癖，相当于西医的乳腺增生病，是乳腺组织的既非炎症也非肿瘤的良性增生性疾病，其特点是单侧或双侧乳房疼痛并出现肿块，乳痛与月经周期及情志变化密切相关，本病例患者为男性，不首先考虑本病（AE错）。乳痨，是乳房部的慢性化脓性疾病，病变后期常有虚劳表现，相当于西医的乳房结核，初期结块特点为大小不等，边界不清，硬而不坚，不痛或微痛，本病例肿块特点与之不符（B错）。乳岩，是指乳房部的恶性肿瘤，相当于西医的乳腺癌，其特点是乳房部出现无痛、发热、皮色不变而质地坚硬的肿块，推之不移，表面不光滑，凹凸不平，或乳头溢血，晚期溃烂，凹如泛莲，本病例特点与之不符（D错）。